通过乙酰基转移酶代谢的是
A. 伯氨喹
B. 琥珀胆碱
C. 异烟肼
D. 氯沙坦
E. 依那普利

正确答案：C。异烟肼

解析：本题考查基因多态性。基因多态性是指群体中正常个体的基因在相同位置上存在差别。研究表明基因的多态性是造成药物反应个体差异的主要原因，一些结核病患者对治疗结核病的药物异烟肼（C对）的反应不一样，是编码N-乙酰基转移酶（NAT-1和NAT-2）的基因差异导致的。